若使用过量，可能导致片剂崩解迟缓的制剂辅料是
A. 表面活性剂
B. 络合剂
C. 崩解剂
D. 稀释剂
E. 黏合剂

正确答案：E。黏合剂

解析：本题考查片剂的常用辅料。黏合剂（E对）系指依靠本身所具有的黏性赋予无黏性或黏性不足的物料以适宜黏性的辅料；表面活性剂系（A错）指能够使液体表面张力下降的物质；络合剂（B错）是指能与金属离子形成络合离子的化合物；崩解剂（C错）指促使片剂在胃肠液中迅速破裂成细小颗粒的辅料；稀释剂（D错）指在主药剂量小于50mg时加入的用来稀释的溶剂。